现代流行病学的形成与发展不包括下面哪个部分
A. 对传染病流行因素的研究
B. 对慢性病流行因素的研究
C. 对疾病防制措施的研究
D. 对疾病临床治疗的研究
E. 流行病学研究方法的发展

正确答案：D。对疾病临床治疗的研究

解析：本题考查现代流行病学的形成与发展。现代流行病学的形成与发展包括：对传染病流行因素的研究（A对）、对慢性病流行因素的研究（B对）、对疾病防制措施的研究（C对）、流行病学研究方法的发展（E对）等。疾病临床治疗的研究（D错，为本题正确答案）属于临床医学的研究范畴，不是现代流行病学的发展过程。